主要通过接触传播的疾病是
A. 疱疹
B. 结核
C. 麻疹
D. 水痘
E. 流感

正确答案：A。疱疹

解析：本题考查经接触传播的疾病。主要通过接触传播的疾病是疱疹（A对）。经接触传播的疾病：病毒性肝炎、疱疹、艾滋病、淋病、梅毒、化脓感染、破伤风。经空气传播的疾病：水痘（D错）、麻疹（C错）、风疹、流行性腮腺炎、流感（E错）、结核（B错）、化脓型感染。